苯与苯乙烯的LC₅₀值均为45mg/L，即其绝对毒性相同，如果考虑到挥发度，苯的挥发度为苯乙烯的11倍
A. 脂/水分配系数与毒效应
B. 电离度与毒效应
C. 挥发度和蒸气压与毒效应
D. 绝对毒性和相对毒性与毒效应
E. 分散度与毒效应

正确答案：D。绝对毒性和相对毒性与毒效应

解析：本题考查绝对毒性和相对毒性与毒效应。苯与苯乙烯的LC₅₀值均为45mg/L，即其绝对毒性相同，如果考虑到挥发度，苯的挥发度为苯乙烯的11倍，说明了绝对毒性和相对毒性与毒效应的关系（D对ABCE错）。